接种单位及其医疗卫生人员发现预防接种异常反应，疑似预防接种异常反应或者接到相关报告的，应当依照预防接种工作规范的及时处理，并
A. 立即报告所在地的县级人民政府卫生主管部门
B. 在1小时内报告所在地的县级人民政府卫生主管部门
C. 立即报告所在地的县级人民政府卫生管理部门和药品监督管理部门
D. 在2小时内报告所在地的县级人民政府卫生主管部门和药品监督主管部门
E. 在1小时内报告所在地的县级人民政府卫生主管部门和药品监督主管部门

正确答案：C。立即报告所在地的县级人民政府卫生管理部门和药品监督管理部门